可引起新生儿黄疸，哺乳期妇女不宜选用的药物是
A. 链霉素
B. 氯霉素
C. 左炔诺孕酮
D. 依那普利
E. 复方磺胺甲噁唑

正确答案：E。复方磺胺甲噁唑

解析：本题考查复方磺胺甲噁唑。可引起新生儿黄疸，哺乳期妇女不宜选用的药物是复方磺胺甲噁唑（E错，为本题正确答案）。某些药物与新生儿的血浆蛋白结合能力强，如磺胺类，如复方磺胺甲噁唑、吲哚美辛等可竞争血红蛋白，致血浆中游离的胆红素浓度升高，胆红素易进入脑细胞内使组织黄染，严重者死亡，故磺胺类药物不宜用于新生儿及早产儿。链霉素（A对）属孕妇用药D类，即对人类有危害，但用药后可能利大于弊，本品可穿过胎盘进入胎儿组织，据报道孕妇应用本品后曾引起胎儿听力损害，因此妊娠妇女在使用本品前必须充分权衡利弊，哺乳期妇女用药期间宜暂停哺乳。氯霉素（B对）：在出生后48小时内即投予高剂量的氯霉素，治疗持续3～4日后可发生灰婴综合征，血药浓度可高达40～200mg/L，临床表现为腹胀、呕吐、进行性苍白、紫绀、微循环障碍，体温不升、呼吸不规则。左炔诺孕酮（C对）因含雌激素和（或）孕激素，可分泌至乳汁中，降低乳汁中吡哆醇含量，使乳儿出现易激惹、尖叫、惊厥等神经精神系统症状；男婴则出现乳房增大。依那普利（D对）对于胎儿，尤其是对后6个月的胎儿有危害，如果在治疗期间怀孕，应改用其他药物以降低对胎儿的危害。